妊娠恶阻的主要发病机制是
A. 脾胃虚弱，化源不足
B. 肝郁气滞，失于条达
C. 痰湿内停，中焦受阻
D. 重伤津液，胃阴不足
E. 冲气上逆，胃失和降

正确答案：E。冲气上逆，胃失和降

解析：发病机制是对疾病发生的病因病机的总的概括，脾胃虚弱，化源不足，孕后冲脉盛，冲气循经上逆犯胃，胃失和降为妊娠恶阻的发病原因之一（A错）。肝郁气滞，失于条达，若郁而化热，上逆犯胃，胃失和降可致恶阻，为妊娠恶阻病因之一（B错）。脾虚痰湿内停者，可出现痰饮上泛的呕恶，为妊娠恶阻脾胃虚弱证日久所致，为其病因之一（C错）。重伤津液，胃阴不足，便秘益甚，腑气不通，可出现呕吐，为妊娠恶阻日久耗伤气阴，胃阴不能下润大肠所致，为妊娠恶阻发病的病因之一（D错）。妊娠恶阻是由于各种原因导致的冲气上逆，胃失和降而发病，故（E对）。